“夺血者无汗”的理论基础是
A. 气能生津
B. 气能行津
C. 气能摄津
D. 津能载气
E. 津血同源

正确答案：E。津血同源

解析：《灵枢·营卫生会》：“夺血者无汗，夺汗者无血。”夺，耗损之意。血汗同出一源，如已经失血的，不能再发其汗；已经发汗的，不能再耗其血。耗血而又发汗，发汗而又耗血，汗血两失，气阴大伤，会加重病情，这是错误的治疗方法。汗属于津液，故其理论基础为津血同源（E对）。气能生津是指气可以促进和激发津液的生成（A错）。气能摄津是指气控制津液及其代谢产物的排泄，以防止体内津液无故流失（C错）。气能行津是指气能推动和调控津液的正常输布运行（B错）